自胎儿娩出脐带结扎开始至生后28天内，按年龄划分，属于
A. 胎儿期
B. 胚胎期
C. 围产期
D. 新生儿期
E. 幼儿期

正确答案：D。新生儿期

解析：新生儿期：自胎儿娩出脐带结扎开始至生后28天内，按年龄划分，此期实际包含在婴儿期之内。掌握“小儿年龄分期”知识点。